有关上腔静脉收集范围的说法，错误的是
A. 收集头部的静脉血
B. 收集颈部的静脉血
C. 收集上肢的静脉血
D. 收集胸腔内全部器官的静脉血
E. 收集胸壁的静脉血

正确答案：D。收集胸腔内全部器官的静脉血

解析：上腔静脉收集范围包括头部（A对）、颈部（B对）、上肢（C对）以及胸壁（E对）的血液。收集胸腔内部分器官的静脉血，而不是全部胸腔内器官（D错，为本题正确答案）。